应将全冠的边缘设计到龈上，需适当增加全冠轴面突度，并增加与邻牙的接触面积的情况是
A. 老年患者牙冠长、冠根比例大
B. 牙体小、轴壁缺损大
C. 以生物学性能较好的金合金做修复材料
D. 患牙（牙合）力大，牙周支持组织差
E. （牙合）龈距离短

正确答案：A。老年患者牙冠长、冠根比例大

解析：本题考查修复体龈边缘设计。全冠的边缘通常应设计到龈上，若需获取较强固位力时可设计龈下边缘；适当增加全冠轴面突度有利于保证修复体的厚度，适当的轴面突度对保护牙龈有重要作用；而增加与邻牙的接触面积可有效地防止食物嵌塞，保护牙龈；老年患者牙冠长、冠根比例大，在设计全冠修复体时，应将全冠的边缘设计到龈上，需适当增加全冠轴面突度，这样可以在视觉上显得牙冠较短，更加美观与协调，同时应增加与邻牙的接触面积（A对），适当减少食物嵌塞。当牙体小、轴壁缺损大时可适当增加轴面突度以恢复正常外形并获得足够强度，但需适当将全冠边缘设计在龈下（B错）。以生物学性能较好的金合金做修复材料适用于龈下边缘，也不一定要求增加全冠轴面突度等（C错）。患牙（牙合）力大，牙周支持组织差时不能增加全冠的轴面突度（D错），否则反而会增加患牙的负担。（牙合）龈距离短时，为了获取足够的固位力，需将全冠边缘设计在龈下（E错）。